女性，55岁。无痛性皮肤、巩膜黄染3月，曾经稍有减退，近1月来呈进行性加重。查体：腹软，右上腹轻压痛，可触及肿大的胆囊，全腹未触及肿块。首先应考虑的疾病是
A. 肝门部胆管癌
B. 壶腹癌
C. 肝癌
D. 胆囊癌
E. 胰体尾部癌

正确答案：B。壶腹癌

解析：老年女性患者，无痛性皮肤、巩膜黄染3月（提示可能存在胆道梗阻），曾经稍有减退（波动性黄疸，提示胆道曾再通，与肿瘤组织坏死脱落有关），近1月来呈进行性加重（梗阻进行性加重）。体查：右上腹轻压痛，可触及肿大的胆囊（提示胆道梗阻），全腹未触及肿块。综合该患者的病史及体查，首先应考虑的疾病是壶腹癌（B对）。肝门部胆管癌（P453）（A错）多表现为进行性黄疸及肝脏肿大，少数病人可有上腹部疼痛，但不会出现胆囊肿大。肝癌（P418）（C错）主要表现为肝区疼痛及肝脏肿大，晚期可出现黄疸，不会出现胆囊肿大。胆囊癌（P452）（D错）早期无特异性症状，晚期主要表现为腹胀、食欲差及恶病质，部分病人可出现黄疸，但黄疸无波动性。胰体尾部癌（E错）距胆道较远，一般不引起胆道梗阻，较少出现黄疸。